旋前圆肌
A. 起于肱骨外上髁
B. 止于桡骨粗隆
C. 构成肘窝的下外侧界
D. 有使前臂旋前和助屈肘作用
E. 属前臂深层肌

正确答案：D。有使前臂旋前和助屈肘作用

解析：旋前圆肌起于肱骨内上髁、前臂深筋膜，而非肱骨外上髁（A错）；止于桡骨外侧面中部，而非桡骨粗隆（B错）；构成肘窝的下内侧界，而非下外侧界（C错）；有使前臂旋前和助屈肘作用（D对）；位于前群第一层肌肉，故属前臂浅层肌，而非深层肌（E错）。